诃子除能敛肺外，还能
A. 止痛
B. 涩肠
C. 固脱
D. 止带
E. 燥湿

正确答案：B。涩肠

解析：本题考查的是诃子的功效。诃子除能敛肺外，还能涩肠（B对）。诃子：【功效】涩肠，敛肺，下气，利咽。海螵蛸：【功效】收敛止血，固精止带，制酸止痛（A错），收湿敛疮。山茱萸：【功效】补益肝肾，收敛固脱（C错）。椿皮：【功效】清热燥湿（E错），涩肠，止血，止带（D错），杀虫。